关于阿替普酶药理作用和临床应用的说法，正确的有
A. 可选择性激活血栓部位的纤溶酶原，不易产生出血反应
B. 血浆消除半衰期较短，为4～5min
C. 应尽早给药，急性缺血性脑卒中的溶栓时间窗为发病后3h内
D. 急性缺血性脑卒中，推荐剂量为0.9mg/kg（最大剂量90mg），总剂量的10%静脉注射，剩余剂量在随后60min持续静脉滴注
E. 有出血性脑卒中病史或不明原因的脑卒中病史的患者禁用

正确答案：A、B、C、D、E。可选择性激活血栓部位的纤溶酶原，不易产生出血反应；血浆消除半衰期较短，为4～5min；应尽早给药，急性缺血性脑卒中的溶栓时间窗为发病后3h内；急性缺血性脑卒中，推荐剂量为0.9mg/kg（最大剂量90mg），总剂量的10%静脉注射，剩余剂量在随后60min持续静脉滴注；有出血性脑卒中病史或不明原因的脑卒中病史的患者禁用

解析：本题考查阿替普酶药理作用和临床应用。阿替普酶具有纤维蛋白特异性，可选择性激活血栓部位的纤溶酶原，不易产生出血反应（A对）。阿替普酶的血浆消除半衰期较短，为4～5min（B对）。急性缺血性脑卒中，推荐剂量为0.9mg/kg（最大剂量为90mg），总剂量的10%先从静脉推入，剩余剂量在随后60分钟持续静脉滴注（D对）。急性缺血性脑卒中的阿替普酶治疗应在症状发作后的3h内开始（C对）。治疗急性心肌梗死时的补充禁忌症是：出血性脑卒中病史或不明起因的脑卒中病史（E对）、过去6个月中有缺血性脑卒中或短暂性脑缺血发作的病史等。